关于糖皮质激素抗炎作用的正确叙述是
A. 对抗各种原因，如物理、生物等引起的炎症
B. 能提高机体的防御功能
C. 促进创口愈合
D. 抑制病原体生长
E. 直接杀灭病原体

正确答案：A。对抗各种原因，如物理、生物等引起的炎症